药师与患者沟通中，常用开放性问题获得所需信息，以下问题中，属于开放性问题的有
A. 您今天早晨吃药了吗？
B. 您出现过药物过敏吗？
C. 您平时去哪里买药？
D. 您会经常忘记吃药吗？
E. 您是如何保证按时服药的？

正确答案：C、E。您平时去哪里买药？；您是如何保证按时服药的？

解析：本题考查开放性问题。属于开放性问题的有：您平时去哪里买药（C对）？您是如何保证按时服药的（E对）？封闭性问题是有针对性的或只需回答“是与否”的问题。您今天早晨吃药了吗（A错）？您出现过药物过敏吗（B错）？您会经常忘记吃药吗（D错）？均属于封闭性问题。